不支持慢性粒细胞白血病加速期的血常规检查结果是
A. 外周血嗜碱性粒细胞＞20%
B. 血小板进行性减少
C. 血小板增高
D. 血红蛋白逐渐下降
E. 外周血原始粒细胞＜10%

正确答案：E。外周血原始粒细胞＜10%

解析：慢性粒细胞白血病加速期血常规检查可见：外周血原始细胞≥10% （E错，为本题正确答案）；外周血碱性粒细胞≥20%（A对）；不明原因的血小板进行性减少或增加（BC对）；血红蛋白逐渐下降（D对）出现贫血。